富含膳食纤维、维生素C的食物是
A. 豆类
B. 蔬菜、水果类
C. 奶类
D. 谷类食物
E. 精制糖

正确答案：B。蔬菜、水果类